女孩，3岁，1个小时前被牵拉右前臂后哭闹不安，不肯用右手持物。查体：右前臂处于半屈旋前位，右肘部轻度压痛，无明显肿胀。X线检查未见明显异常。最可能的诊断是
A. 桡骨头半脱位
B. 桡神经损伤
C. 正中神经损伤
D. 肘关节脱位
E. 尺神经损伤

正确答案：A。桡骨头半脱位

解析：患儿前臂牵拉史，查体见右前臂处于半屈旋前位，右肘部轻度压痛，X线检查未见明显异常，故最可能的诊断是桡骨头半脱位（A对）。桡神经损伤（B错）（P701）的典型表现为垂腕、垂指、垂拇畸形。正中神经损伤（P700）（C错）的主要表现为拇指对掌功能障碍、猿手畸形。肘关节脱位（D错）主要表现为肘后突畸形、肘后三角关系改变。尺神经损伤（E错）（P701）易在腕部和肘部损伤，腕部损伤主要表现为爪形手畸形、手指内收、外展障碍及Froment征阳性。